贝毒或赤潮藻类毒素引起的人类中毒死亡事件中，主要是因为
A. 麻痹性贝毒
B. 腹泻性贝毒
C. 记忆缺失性贝毒
D. 肝损伤性贝毒
E. 神经性贝毒

正确答案：A。麻痹性贝毒

解析：本题考查贝毒。贝毒可分为麻痹性贝毒、腹泻性贝毒、记忆缺失性贝毒、神经性贝毒和西加鱼毒。在赤潮藻毒素引起的中毒和死亡事件中87%由麻痹性贝毒（A对BCDE错）引起，其次是腹泻性贝毒。